下列不是非处方药遴选原则的是
A. 应用安全
B. 国际接轨
C. 疗效确切
D. 质量稳定
E. 使用方便

正确答案：B。国际接轨

解析：本题考查非处方药遴选原则。下列不是非处方药遴选原则的是国际接轨（B错，为本题正确答案）。国际接轨不是非处方药遴选原则。非处方药的遴选原则是：应用安全（A对）、疗效确切（C对）、质量稳定（D对）、使用方便（E对）。